非选择性抑制环氧酶的药物是
A. 阿司匹林
B. 布桂嗪
C. 塞来昔布
D. 秋水仙碱
E. 丙吡胺

正确答案：A。阿司匹林

解析：本题考查阿司匹林。阿司匹林（A对）为非选择性环氧酶抑制剂，能同时抑制COX-2及血小板COX-1，具有抗炎及抑制血小板聚集作用。布桂嗪（B错）为速效镇痛药。塞来昔布（C错）为选择性COX-2抑制剂。秋水仙碱（D错）为选择性抗痛风关节炎药。丙吡胺（E错）属Ia类抗心律失常药。